28岁女性，产后6个月，月经周期缩短，妇科检查无异常。基础体温曲线呈双相型，提示为
A. 无排卵型功血
B. 子宫内膜不规则脱落
C. 黄体功能不足
D. 早期妊娠
E. 不能确定诊断

正确答案：C。黄体功能不足

解析：患者为年轻女性，产后6个月，月经周期缩短（黄体功能不足一般表现为月经周期缩短），妇科检查无异常。基础体温曲线呈双相型（提示有排卵，不是无排卵性功血（A错）），提示为黄体功能不足（C对E错）。子宫内膜不规则脱落（B错）表现为月经在周期正常、经期延长、经量增多。早期妊娠（P42）（D错）主要表现为停经、早孕反应、乳房和生殖系统的变化，而不是月经周期缩短。